氯喹的药理作用特点为
A. 对疟原虫红细胞内期裂殖体具杀灭作用
B. 在肝中浓度高，是治疗阿米巴肝脓肿的主要药物
C. 偶尔用于类风湿性关节炎
D. 在红细胞内药物浓度比血浆内高10～20倍
E. 在肝、肾、脾、肺中的浓度为血浆浓度的200倍以上

正确答案：A、B、C、D、E。对疟原虫红细胞内期裂殖体具杀灭作用；在肝中浓度高，是治疗阿米巴肝脓肿的主要药物；偶尔用于类风湿性关节炎；在红细胞内药物浓度比血浆内高10～20倍；在肝、肾、脾、肺中的浓度为血浆浓度的200倍以上